对肱骨外上髁炎有诊断意义的检查是
A. Mills征
B. Thomas征
C. Spurling征
D. Dugas征
E. “4”字试验

正确答案：A。Mills征

解析：肱骨外上髁炎是伸肌总腱起点处的一种慢性损伤性炎症，病人肘关节外侧疼痛，在用力握拳、伸腕时疼痛加重以致不能持物，对其有诊断意义的检查是Mills征（A对），即伸肘，握拳，屈腕，前臂旋前时，肘外侧出现疼痛。Thomas征（P758）（B错）用来检查髋关节有无屈曲畸形。Spurling征（压头试验）（P726）（C错）用于神经根型颈椎病的诊断。Dugas征（P631）（D错）用于肩关节脱位的诊断。 “4”字试验（P757）（E错）多用于髋关节结核等髋关节疾病的诊断。